男，40岁。从三楼跌下，左6、7、8肋骨骨折，脾破裂、肠破裂。入院时精神紧张，T38.5度，面色苍白肢端冰冷，脉搏细速，P110次/分，血压130/100mmHg，尿量减少。目前不宜紧急进行的检査是
A. 血常规
B. 腹腔穿刺
C. 中心静脉压测定
D. 静脉肾盂造影
E. 测定二氧化碳结合力

正确答案：D。静脉肾盂造影

解析：患者高空坠落导致肋骨骨折、脾破裂、肠破裂，出现精神紧张、面色苍白、肢端冰冷、脉搏细速、尿量减少等表现，提示出现失血性休克。患者P110次/分，血压130/100mmHg，提示患者处于休克前期。此时不宜过多搬动患者行肾盂造影（D错，为本题正确答案），且少尿说明肾脏排泄能力较低，注射造影剂后不易排出，加重肾脏负担。对于腹部闭合性损伤，脾破裂，肠破裂的患者，应首选腹腔穿刺（B对）以明确诊断。该患者处于失血性休克前期，应急查血常规（A对）以了解红细胞压积、测定中心静脉压（C对）以指导补液、测定二氧化碳结合力（E对）以了解酸碱失衡情况。